牙弓的宽度是指
A. 左、右第一磨牙颊面间最宽的距离
B. 左、右第二磨牙颊面间最宽的距离
C. 左、右第三磨牙颊面间最宽的距离
D. 左、右第一前磨牙颊面间最宽的距离
E. 左、右第二前磨牙颊面间最宽的距离

正确答案：B。左、右第二磨牙颊面间最宽的距离

解析：本题考查牙列。弓宽度的测量：一般测量牙弓三个部位的宽度，即牙弓前段宽度(左右尖牙牙尖间的宽度)，牙弓中段宽度(左右第一前磨牙中央窝间的宽度)，牙弓后段宽度(左右第一磨牙中央窝间的宽度)。也有学者将左右第二磨牙颊面间最宽的距离（B对）定为牙弓宽度。